在临床医学研究中应切实保护受试者的利益，下列除外哪一项均对
A. 实验研究前必须经过动物实验
B. 实验研究前必须制定严密科学的计划
C. 实验研究前必须有严格的审批监督程序
D. 实验研究前必须详细了解病人身心情况
E. 实验研究结束后必须作出科学报告

正确答案：E。实验研究结束后必须作出科学报告